女，5岁。因低热盗汗及干咳2个月入院，体检：T38℃，消瘦，面色苍白，两肺呼吸音清，OT试验（+++），中性粒细胞稍高，血培养（-），胸片示肺门淋巴结肿大，可能的诊断是
A. 败血症
B. 急性风湿热
C. 原发型肺结核
D. 大叶性肺炎
E. 肺不张

正确答案：C。原发型肺结核

解析：患儿有低热、盗汗、干咳的典型结核症状，OT试验（结核菌素试验）强阳性，提示有结核杆菌感染。胸片提示肺门淋巴结肿大，可诊断为原发性肺结核（C对）。败血症（A错）有黄疸、肝脾肿大、出血、休克等症状。急性风湿热（B错）无肺门淋巴结肿大。大叶性肺炎（D错）和肺不张（E错）都有肺部异常体征。